痰滞于胃，则
A. 恶心呕吐
B. 神志昏糊
C. 肢体麻木
D. 痰核瘰疬
E. 咳嗽气喘

正确答案：A。恶心呕吐

解析：痰饮可以阻滞气机，停于胃，胃失和降，则见恶心呕吐（A对）。神志昏糊（B错）是由于痰浊上泛，夹风、火，蒙蔽心窍，扰乱神明所致。肢体麻木（C错）是用于痰饮可以阻滞气血运行，如流注经络，则经络阻滞，气血运行不畅所致。痰核瘰疬（D错）是因为结于局部所形成的。胸闷气喘、咳嗽吐痰（E错）是由于痰饮阻滞，肺失宣降所致。